阑尾的下述说法，何者错误
A. 位置变化很大
B. 通常为腹膜内位器管
C. 阑尾系膜一般均呈三角形
D. 系膜的游离缘有阑尾血管经过
E. 外径介于0.5～1.0cm之间，管腔狭小

正确答案：D。系膜的游离缘有阑尾血管经过

解析：阑尾尖端游离，所以其位置变化较大(A对)，为腹膜内位器官(B对)，阑尾系膜有三角形和扇形，一般呈三角形(C对)，系膜游离缘只有神经走行，无血管(D错，为本题正确答案)，管径在0.5～1.0cm之间，官腔狭窄(E对)。阑尾血管主要由阑尾动静脉组成，位于阑尾系膜游离缘。阑尾动脉是末梢动脉，与其他器官无侧支循环，当血液供应受阻时，容易引起阑尾坏死。当阑尾发炎时，细菌会沿着静脉回流到门静脉或肝脏，形成门静脉炎或肝脓肿